血清与血浆的主要不同点是前者不含
A. 钙离子
B. 球蛋白
C. 清蛋白
D. 凝集素
E. 纤维蛋白原

正确答案：E。纤维蛋白原